下列抗高血压药物中，哪一种药物易引起刺激性干咳
A. 维拉帕米
B. 卡托普利
C. 氯沙坦
D. 硝苯地平
E. 普萘洛尔

正确答案：B。卡托普利

解析：卡托普利可引起肺血管床内缓激肽及前列腺素等物质的聚积，出现刺激性干咳、血管神经性水肿，一般停药后可自行消失（B对）。